牙外伤伴牙周膜损伤者，根管治疗后进行桩冠修复的最短时间为
A. 3天
B. 7天
C. 14天
D. 18天
E. 21天

正确答案：B。7天

解析：本题考查桩核冠修复的时间。牙外伤伴牙周膜损伤者，根管治疗后进行桩冠修复的最短时间为7天（B对）。成功根管治疗后1～2周；活髓牙或急、慢性牙髓炎尚未累及根尖周者，根管治疗3天后无根尖周症状就可以做桩冠；急性化脓性牙髓炎伴有根尖周症状或发生牙髓坏死，坏疽者，应观察1周后才可以做桩冠；18岁以下不宜做桩冠；严重的根尖吸收，牙槽骨吸收超过根长1/3者，不宜做桩冠；桩冠的长度要求根尖部保留3～5mm的充填材料，冠桩的长度约为根长的2/3～3/4；理想的冠桩直径应为根径的1/3。